下列哪种情况不是经空气传播的传染病流行特点
A. 传播途径容易实现，传播广泛，发病率高
B. 有明显的季节性，冬春季高发
C. 在形成免疫的人群中，发病呈周期性
D. 居住拥挤和人口密度大的地区高发

正确答案：C。在形成免疫的人群中，发病呈周期性

解析：本题考查经空气传播的特征。经空气传播的传染病流行特征为：①传播途径容易实现，传播广泛，发病率高（A对）；②有明显的季节性，冬春季高发（B对）；③在没有免疫预防人群中，发病呈周期性（C错，为本题正确答案）；④居住拥挤和人口密度大的地区高发（D对）。